补骨脂具有的功效是
A. 补气健脾
B. 温脾止泻
C. 祛风除湿
D. 固表止汗
E. 益气生津

正确答案：B。温脾止泻

解析：补骨脂药性辛、苦，温。归肾、脾经。功效是温肾助阳，温脾止泻，纳气平喘；外用消风祛斑（B对）。太子参的功效是补气健脾（A错），生津润肺。藁本的功效是祛风除湿（C错），散寒止痛。麻黄根的功效是固表止汗（D错）。五味子的功效是收敛固涩，益气生津（E错），补肾宁心。